阑尾炎术后，肠道恢复蠕动的表现
A. 肛门排气
B. 压痛反跳痛消失
C. 腹胀消失
D. 有饥饿感
E. 腹痛消失

正确答案：A。肛门排气

解析：患者阑尾炎术后，会出现胃肠道蠕动减弱的表现，容易造成粘连性肠梗阻，若出现肠鸣音或肛门排气（A对），则代表胃肠道开始恢复蠕动。腹痛（E错）、腹胀（C错）、压痛反跳痛（B错）均为急性阑尾炎的临床表现，不属于阑尾术后肠道恢复蠕动的临床表现。阑尾手术后，机体静息能量消耗增高、高血糖及蛋白质分解增强，患者出现饥饿感（D错）属于正常现象，应合理补充营养。